龟甲的归经是
A. 肺、胃、肾经
B. 肺、脾、肾经
C. 心、脾、肾经
D. 心、肝、肾经
E. 心、肝、脾经

正确答案：D。心、肝、肾经

解析：龟甲甘能滋补，质重镇潜，寒能清泄，入肝、肾、心经（D对）。归肺、胃、肾经（A错）的中药有知母、玄参、海蛤壳等。归肺、脾、肾经（B错）的中药有京大戟、芫花、商陆等。归心、脾、肾经（C错）的中药有附子。归心、肝、脾经（E错）的中药有乳香、没药、苏木等。